脊柱结核与脊柱肿瘤的鉴别诊断中最有价值的检查是
A. 穿刺活检
B. 脊髓造影
C. 血沉
D. X线平片
E. B超

正确答案：A。穿刺活检

解析：脊柱结核儿童、成人均可发生，起病缓慢，有午后低热盗汗、疲倦、消瘦、食欲差与贫血等全身症状（P754）。 X线平片表现以骨质破坏和椎间隙狭窄为主（P754）。脊柱肿瘤多见于老人，疼痛逐日加重，X线平片可见骨质破坏累及椎弓根，椎间隙高度正常，一般无椎旁软组织块影（P755）。行穿刺活检检出有无癌细胞是脊柱结核与脊柱肿瘤的鉴别诊断中最有价值的检查（A对）。脊柱结核一般不侵犯脊髓，脊柱肿瘤在未侵犯到脊髓前无特征改变，因此脊髓造影（B错）意义不大。血沉（C错）改变为一般表现，对脊柱结核与脊柱肿瘤的鉴别诊断无意义。X线平片（D错）对脊柱结核与脊柱肿瘤的鉴别诊断有一定意义，但是不如穿刺活检准确。B超（E错）一般不作为脊柱结核与脊柱肿瘤的鉴别诊断的首选检查，更不可能成为最有价值的检查。